下列哪项是传染源
A. 病原携带者
B. 传染病患者
C. 受感染的动物
D. 有血吸虫尾蚴的钉螺
E. 以上都是

正确答案：E。以上都是